反映工具的有效性、正确性的是
A. 测验的信度
B. 测验的样本
C. 测验的概念
D. 测验的常模
E. 测验的效度

正确答案：E。测验的效度

解析：效度反映工具的有效性、正确性。掌握“信度、效度和常模”知识点。